治疗温病气分证和疮溃不敛的药物是
A. 石膏
B. 夏枯草
C. 知母
D. 芦根
E. 淡竹叶

正确答案：A。石膏

解析：石膏功效为：生用清热泻火，除烦止渴；煅用收湿，生肌，敛疮，止血。用治温热病邪在气分之壮热、溃疡不敛（A对）。夏枯草功效为清肝泻火，明目，散结消肿。治疗目赤肿痛，目珠夜痛，头痛眩晕；瘿瘤，瘰疬；乳痈，乳癖，乳房胀痛（B错）。知母功效为清热泻火，滋阴润燥。治疗外感热病，高热烦渴；肺热咳嗽，阴虚燥咳；骨蒸潮热；内热消渴；阴虚肠燥便秘（C错）。芦根功效为清热泻火，生津止渴，除烦，止呕，利尿。治疗热病烦渴；肺热咳嗽，肺痈吐脓；胃热呕哕；热淋涩痛（D错）。淡竹叶功效为清热泻火，除烦止渴，利尿通淋。治疗热病烦渴；口舌生疮，小便短赤涩痛（E错）。